在一项队列研究中，计算出某研究因素RR值的95%的可信区间为0.2～0.8，那么该研究因素可能为
A. 危险因素
B. 保护因素
C. 混杂因素
D. 无关因素
E. 以上均不是

正确答案：B。保护因素

解析：本题考查RR的95%置信区间。当RR95%置信区间均大于1时，该因素是危险因素；当RR95%置信区间均在0～1之间，该因素是保护因素（B对ACDE错）；当RR95%置信区间包含1时，该因素为无关因素。